腮腺床不包括
A. 颈内动脉
B. 颈外动脉
C. 颈内静脉
D. 舌咽神经
E. 舌下神经

正确答案：B。颈外动脉

解析：腮腺深叶的深面与茎突诸肌及围以蜂窝组织的深部血管神经（颈内动、静脉和第IX～XII对脑神经）向毗邻。上述结构称为“腮腺床”。即腮腺床由三组结构组成：①颈内血管（av）；②起于茎突（乳突后内侧）的茎突舌骨肌、茎突舌肌、茎突咽肌；③后四对脑神经：舌咽、迷走、副、舌下神经。掌握“腮腺咬肌区、腮腺与面神经解剖关系”知识点。